有机磷杀虫药中毒的主要机制
A. 促使乙酰胆碱水解
B. 抑制心血管运动中枢
C. 兴奋交感神经系统
D. 抑制胆碱酯酶活性
E. 抑制呼吸中枢

正确答案：D。抑制胆碱酯酶活性

解析：有机磷杀虫药中毒的主要机制为有机磷酸酯进入人体后，可与乙酰胆碱酯酶牢固结合，形成难以水解的磷酰化胆碱酯酶，失去水解乙酰胆碱的能力，造成了胆碱的堆积，抑制一系列中毒症状，若不及时抢救，胆碱酯酶可在几分钟至几小时内发生老化而失去重新活化的能力，此时即使使用胆碱酯酶复活剂也难以恢复酶的活性（D对A错）。有机磷酸酯中毒后可表现为中枢神经系统现兴奋后抑制（C错），腺体分泌增多引起呼吸困难，继而呼吸衰竭、循环系统衰竭引起死亡，不能抑制呼吸中枢（E错）。有机磷酸酯中毒机制与心血管运动中枢无关（B错）。